男，40岁。上腹部不适伴纳差1个月。既往体健。胃镜检查结果为黏膜相关性淋巴样组织淋巴瘤。与该病发生密切相关的病原体是
A. 军团菌
B. 粪肠球菌
C. 幽门螺杆菌
D. 产气肠杆菌
E. 大肠埃希菌

正确答案：C。幽门螺杆菌

解析：中年男性（青壮年男性发病较高），上腹部不适伴纳差，胃镜检查结果为黏膜相关性淋巴样组织淋巴瘤，根据患者症状、检查结果，考虑是胃黏膜相关B细胞淋巴瘤（MALT），（MALT）的发生与幽门螺杆菌（C对）密切相关。军团菌（P167）（A错）引起一种叫庞蒂亚克热的疾病，即临床表现为轻型的军团病。肠球菌属中对人类致病者主要为粪肠球菌（B错）和屎肠球菌，是医院感染的重要病原菌，主要引起尿路感染、腹腔感染、盆腔感染、败血症、心内膜炎等。产气肠杆菌（D错）为条件致病菌，与泌尿道、呼吸道和伤口感染有关，偶引起败血症和脑膜炎。大肠埃希菌（E错）在宿主免疫力下降或细菌侵入肠道外组织器官后，即可成为机会致病菌，引起肠道外感染。